发生自然灾害、传染病流行、突发重大伤亡事故以及其他严重威胁人民生命健康的紧急情况时，不服从卫生行政部门调遣的，给予的处理是
A. 暂停执业活动三个月至六个月
B. 暂停执业活动六个月至一年
C. 给予行政处分
D. 暂停执业活动六个月至一年，吊销医师执业证书
E. 追究刑事责任

正确答案：D。暂停执业活动六个月至一年，吊销医师执业证书

解析：《中华人民共和国执业医师法》规定，医师在执业活动中，违反本法规定的，由县级以上人民政府卫生行政部门给予警告或责令暂停6个月以上1年以下执业活动；情节严重的，吊销其执业证书；构成犯罪的，依法追究刑事责任。发生自然灾害、传染病流行、突发重大伤亡事故以及其他严重威胁人民生命健康的紧急情况时，不服从卫生行政部门调遣，情节严重，但尚未构成犯罪，因此，给予的处理是暂停执业活动六个月至一年，吊销医师执业证书（D对）。